上腹痛具有周期性和节律性，呕吐物呈咖啡残渣样，临床上最可能的诊断
A. 急性胃黏膜病变
B. 慢性胃炎
C. 胃溃疡
D. 胃癌
E. 胃黏膜脱垂症

正确答案：C。胃溃疡

解析：胃溃疡（C对）是由于胃酸和胃蛋白酶对黏膜自身消化所形成的，上腹部疼痛是本病的主要症状，多在餐后1小时内出现，经1～2小时后逐渐缓解，直至下餐进食后再复现上述节律，具有周期性和节律性，胃溃疡出血时，呕吐物呈咖啡残渣样。急性胃黏膜病变（A错）可有出血，呕吐物呈咖啡残渣样，但是疼痛没有周期性和节律性改变。慢性胃炎（B错）的疼痛没有周期性和节律性改变，且很少出血。胃癌（D错）的疼痛呈持续性，可出现咖啡残渣样呕吐物。胃黏膜脱垂症（E错）常以腹痛、上消化道出血、恶心呕吐为主要临床表现，其中腹痛是最常见的表现，无明显的周期性和节律性。